能使氧化磷酸化减慢的物质是
A. ATP
B. ADP
C. CoASH
D. 还原当量
E. 琥珀酸

正确答案：A。ATP